引起慢性龈炎的局部刺激因素如下，除外
A. （牙合）面充填物高点
B. 食物嵌塞
C. 牙列不齐
D. 牙石
E. 不良修复体

正确答案：A。（牙合）面充填物高点

解析：本题考查慢性龈炎的病因。引起慢性龈炎的局部刺激因素如下，除外（牙合）面充填物高点（A错，为本题的正确答案）。龈缘附近牙面上堆积的牙菌斑是慢性龈炎的始动因子，其他如牙石（D对）、食物嵌塞（B对）、不良修复体（E对）、牙错位拥挤（C对）、口呼吸等因素均可促进菌斑的积聚，引发或加重牙龈的炎症。龈炎时，龈缘附近一般有较多的菌斑堆积，菌斑中细菌的量也较牙周健康时多，种类也较复杂，此时菌斑中球菌的比例较健康时下降，而G⁻菌明显增多，产黑色素类杆菌、梭形杆菌和螺旋体比例增高，虽然仍低于深牙周袋中此类细菌的比例，但已明显高于牙周健康时菌斑中此类细菌的比例。